有助于判断中骨盆狭窄的重要指标是
A. 骶耻外径
B. 髂嵴间径
C. 髂棘间径
D. 坐骨结节间径
E. 坐骨切迹宽度

正确答案：E。坐骨切迹宽度

解析：坐骨切迹宽度（E对）为坐骨棘与骶骨下部间的距离，代表中骨盆后矢状径，是判断中骨盆狭窄的重要指标。骶耻外径（P146）（A错）能间接推测骨盆入口前后径的长度，是骨盆外测量中最重要的径线。髂嵴间径（P146）（B错）是测量两髂嵴外缘最宽的距离。髂棘间径（P146）（C错）是测量两髂前上棘外缘的距离。坐骨结节间径（P146）（D错）是测量两坐骨结节内侧缘的距离，与骨盆出口平面狭窄有关。